下列哪项不是芮氏线与埃布纳线的区别的是
A. 位于牙齿的位置不同
B. 代表牙齿硬组织的沉积性周期不同
C. 可观察到新生线
D. 两种生长线的朝向不同
E. 两种生长线的镜下表现不同

正确答案：C。可观察到新生线

解析：芮氏线与牙本质生长线的区别如下：芮氏线：深褐色同心圆（横断磨片，类似年轮），牙尖部呈环形（纵向磨片），代表5～10天的釉质沉积速度，乳牙和六龄牙上可见到一条加重的新生线，是研究釉质发育的一个标志。牙本质生长线：分两类，一类为短时生长线（约每天生长4μm），另一类为长期生长线（或5天生长线），代表5天的周期性生长，又称埃布纳线。朝向根方沉积的标志。牙本质也因部分形成与出生前和出生后两者之间有一条明显的生长线，称为新生线。掌握“牙釉质”知识点。